造成阻塞性通气不足的原因是
A. 呼吸肌活动障碍
B. 胸廓顺应性降低
C. 肺顺应性降低
D. 气道阻力增加
E. 弥散障碍

正确答案：D。气道阻力增加

解析：造成阻塞性通气不足的原因是气道内径变窄或不规则引起的气道阻力增加（D对）。